肺根中主要结构由前向后的排列关系依次为
A. 肺动脉、肺静脉、支气管
B. 肺动脉、支气管、肺静脉
C. 肺静脉、肺动脉、支气管
D. 肺静脉、支气管、肺动脉
E. 无

正确答案：C。肺静脉、肺动脉、支气管

解析：肺根内的主要结构由前向后的排列关系依次为：肺静脉、肺动脉、支气管（C对）”。